阿昔洛韦的化学名为
A. 9-（2-羟乙氧甲基)鸟嘌呤
B. 9-（2-羟乙氧甲基)黄嘌呤
C. 9-（2-羟乙氧甲基)腺嘌呤
D. 9-（2-羟乙氧乙基)鸟嘌呤
E. 9-（2-羟乙氧乙基)黄嘌呤

正确答案：A。9-（2-羟乙氧甲基)鸟嘌呤